以显性感染为主的传染病是
A. 流感
B. 麻疹
C. 狂犬病
D. 脊髓灰质炎
E. 甲型病毒性肝炎

正确答案：B。麻疹

解析：本题考查以显性感染为主的传染病。以显性感染为主的传染病中，有明显临床症状和体征的感染者居多，隐性感染较少，重症和死亡病例极少，如水痘、麻疹（B对ACDE错）等。